治疗小儿水肿脾肾两虚证，应首选
A. 健脾益气，参苓白术散
B. 补脾温肾，附子理中汤
C. 温阳救逆，参附龙牡汤
D. 温肾健脾，真武汤
E. 温阳扶正，参附汤

正确答案：D。温肾健脾，真武汤

解析：小儿水肿脾肾两虚者，当治本为要，法当温肾健脾，化气行水，应用真武汤加减（D对）。健脾益气之法用于脾虚泻，方用参苓白术散（A错）。补脾温肾应用于泄泻之脾肾阳虚证，方用附子理中汤加减（B错）。温阳救逆之法用于泄泻阳脱证，方用参附龙牡汤（C错）。温阳扶正适用于阳虚证，且参附汤无行气利水之功（E错）。